下列哪项组合不正确
A. 急粒白血病一可见Auer小体
B. M3白血病一t（15；17）
C. 急淋白血病一过氧化酶阳性+
D. 慢粒白血病一NAP下降
E. 慢淋白血病一以成熟小淋巴细胞为主

正确答案：C。急淋白血病一过氧化酶阳性+

解析：急性淋巴细胞白血病过氧化酶阴性（C错，为本题正确答案），过氧化酶阳性见于急性粒细胞白血病；急粒白血病、急单白血病可见Auer小体（A对）；M₃白血病患者约99%有t（15；17）改变（B对）；慢性粒细胞白血病有中性粒细胞成熟障碍，中性粒细胞碱性磷酸酶NAP活性下降（D对）；慢淋白血病（P580）细胞形态类似成熟小淋巴细胞，但是一种免疫学不成熟、功能异常的细胞，E选项说法欠准确。